外科引流应该遵循的基本原则是
A. 通畅、彻底
B. 对组织损伤或干扰最小
C. 顺应解剖和生理要求
D. 确定病原菌
E. 以上答案均正确

正确答案：E。以上答案均正确

解析：外科引流应遵循以下5项基本原则，即通畅、彻底、对组织损伤或干扰最小、顺应解剖和生理要求、确定病原菌。掌握“口外手术打结、缝合及外科引流”知识点。